以下哪一项不属于慢性牙髓炎的分类
A. 慢性闭锁性牙髓炎
B. 慢性溃疡性牙髓炎
C. 溃疡型慢性增生性牙髓炎
D. 上皮型慢性增生性牙髓炎
E. 牙髓网状变性

正确答案：E。牙髓网状变性

解析：本题考查急、慢性牙髓炎。牙髓网状变性（E错，为本题正确答案）不属于慢性牙髓炎的分类。慢性牙髓炎是临床最常见的一种牙髓炎，根据牙髓腔是否穿通分为慢性闭锁性牙髓炎（A对）和慢性开放性牙髓炎。慢性开放性牙髓炎又分为慢性溃疡性牙髓炎（B对）和慢性增生性牙髓炎（CD对）。